出现反常性碱性尿现象的是
A. 机体缺氧
B. 大量使用碳酸酐酶抑制剂
C. 摄入大量成酸性药物
D. 酮症酸中毒
E. 腹泻

正确答案：B。大量使用碳酸酐酶抑制剂

解析：大量使用碳酸酐酶抑制剂（B对）可抑制碳酸酐酶活性，导致HC03-在近曲小管重吸收减少，尿中排出增多，引起反常性碱性尿。